下述正常人摄取糖类过多时的几种代谢途径中，哪一项是错误的
A. 糖转变为非必需氨基酸
B. 糖转变为蛋白质
C. 糖转变为脂肪
D. 糖转变为脱氧核糖
E. 合成糖原

正确答案：B。糖转变为蛋白质

解析：血糖的去路主要有：①葡萄糖在各组织中氧化分解供能，这是血糖的主要去路。②葡萄糖在肝、肌肉等组织中合成糖原。③转变为非糖物质，如脂肪、非必需氨基酸、多种有机酸等。④转变为其他糖及衍生物，如核糖、脱氧核糖、唾液酸、氨基糖等。⑤当血糖浓度过高时，超过了肾糖阈（约8.89mmol/L）时，葡萄糖即由尿中排出，出现糖尿。掌握“磷酸戊糖与血糖调节”知识点。